能与茜草素反应，显蓝色的是
A. Feigl反应
B. 无色亚甲蓝显色试验
C. Keller-Kiliani反应
D. Bornträger's反应
E. 与金属离子的络合反应

正确答案：E。与金属离子的络合反应